以下属于生存数据特点的是
A. 同时考虑生存时间和生存结局
B. 通常含有删失数据
C. 生存时间的分布通常不服从正态分布
D. 以上都对
E. 以上都不对

正确答案：D。以上都对

解析：本题考查生存数据的特点。生存数据的特点包括：①同时考虑生存时间和生存结局；②通常含有删失数据；③生存时间的分布通常不服从正态分布（D对ABCE错）。